男性患者，35岁。左下6（牙合）面隐裂累及牙髓，已完成根管治疗，牙冠短小，咬合紧，宜用哪种修复体
A. 高嵌体
B. 3/4冠
C. 邻（牙合）嵌体
D. 铸造全冠
E. 锤造全冠

正确答案：D。铸造全冠

解析：本患者适用铸造冠。铸造金属全冠的适应证为：①后牙冠缺损较严重，采用其他修复体难以获得足够固位力。②大面积充填后的死髓牙，防止牙冠劈裂。③后牙低位，邻接不良，牙冠畸形或错位牙等，需以修复体恢复正常形态、咬合、邻接系及排列关系者。④牙本质过敏严重伴有牙体缺损，采用一般治疗难以见效者。掌握“铸造金属全冠”知识点。